法定传染病以外的其他传染病，根据其暴发、流行情况和危害程度，需要列入乙类、丙类传染病的，应当由下列哪个部门决定
A. 国务院
B. 国务院卫生行政部门
C. 省级以上人民政府
D. 省级以上人民政府卫生行政部门
E. 国家疾病控制中心

正确答案：B。国务院卫生行政部门